药物的生物利用度是指
A. 药物经胃肠道进入门脉的分量
B. 药物能吸收进入体循环的分量
C. 药物吸收后达到作用点的分量
D. 药物吸收后进入体内的相对速度
E. 药物吸收进入全身血液循环内药物的百分率

正确答案：E。药物吸收进入全身血液循环内药物的百分率

解析：经任何给药途径给予一定剂量的药物后到达全身血液循环内药物的百分率称生物利用度。掌握“药物消除及重要参数”知识点。